性味辛温的活血祛瘀药是
A. 丹参
B. 艾叶
C. 半夏
D. 川芎
E. 郁金

正确答案：D。川芎

解析：本题考查的是川芎的性味归经及功效。性味辛温的活血祛瘀药是川芎（D对）。川芎：【性味归经】辛，温。归肝、胆、心包经。【功效】活血行气，祛风止痛。丹参（A错）：【性味归经】苦，微寒。归心、肝经。【功效】活血祛瘀，通经止痛，清心除烦，凉血消痈。艾叶（B错）：【性味归经】辛、苦，温。归肝、脾、肾经。【功效】温经止血，散寒止痛。半夏（C错）：【性味归经】辛，温。有毒。归脾、胃、肺经。【功效】燥湿化痰，降逆止呕，消痞散结。郁金（E错）：【性味归经】辛、苦，寒。归心、肝、胆、肺经。【功效】活血止痛，行气解郁，凉血清心，利胆退黄。